结构与对氨基苯甲酸类似，通过代谢拮抗方式产生抗菌活性的药物是
A. 磺胺嘧啶
B. 氟康唑
C. 特比萘芬
D. 头孢克洛
E. 克拉维酸

正确答案：A。磺胺嘧啶

解析：本题考查磺胺嘧啶。结构与对氨基苯甲酸类似，通过代谢拮抗方式产生抗菌活性的药物是磺胺嘧啶（A对）。磺胺嘧啶在结构和电性与对氨基苯甲酸相似。如果改变其相似性则抗菌活性降低，反之保持其相似性则保持抗菌活性。氟康唑（B错）属于三唑类抗菌药。特比萘芬（C错）是丙烯胺类抗真菌药。头孢克洛（D错）是头孢氨苄的C-3位甲基被氯原子取代得到的可口服的半合成头孢菌素。克拉维酸（E错）是天然来源的β-内酰胺酶抑制剂。